6个月以后婴儿容易发生小细胞低色素性贫血的最主要原因是
A. 生长发育需要量增大
B. 未及时添加含铁丰富的辅食
C. 人工喂养铁的吸收率低
D. 膳食总热量不足
E. 添加淀粉类食品过多

正确答案：B。未及时添加含铁丰富的辅食

解析：婴儿容易发生小细胞低色素性贫血（缺铁性贫血）的最主要原因有铁摄入量不足，人乳、牛乳、谷物中含铁量均低，需于4～6月始及时添加适量含铁辅食（B对）。生长发育需要量大（A错），若及时补充含铁辅食，亦不会患病。因此B为最佳选项。